活化后能产生氧自由基的细胞是
A. 红细胞
B. 白细胞
C. 肌细胞
D. 内皮细胞
E. 血小板

正确答案：B。白细胞

解析：白细胞（B对）包括中性粒细胞、淋巴细胞、单核细胞、嗜酸性粒细胞和嗜碱性粒细胞，电离辐射、氧合血红蛋白氧化分解、中性粒细胞及巨噬细胞吞噬细菌的过程、光敏反应、某些抗癌药物等在体内可产生自由基。